医院感染发生率是指
A. 一定时期内，在所有入院患者中发生医院感染新病例数的频率
B. 一定时期内，同期住院患者中新发生医院感染例次的频率
C. 观察期内，医院感染总病例数占同期住院患者总数的比例
D. 与指示病例有效接触后--个最长潜伏期内，在接触者中续发病例数与接触者总数的比值
E. 一定期限内，医院感染发病人数占该地区总人口数的比例

正确答案：A。一定时期内，在所有入院患者中发生医院感染新病例数的频率